切面韧皮部有红棕色至黑棕色分泌物，与木质部相间排列呈数个同心性椭圆形环或偏心性半圆形环的药材是
A. 鸡血藤
B. 大血藤
C. 降香
D. 苏木
E. 川木通

正确答案：A。鸡血藤

解析：本题考查的是鸡血藤药材的性状鉴别。切面韧皮部有红棕色至黑棕色分泌物，与木质部相间排列呈数个同心性椭圆形环或偏心性半圆形环的药材是鸡血藤（A对）。鸡血藤：【性状鉴别】药材呈椭圆形、长矩圆形或不规则的斜切片。栓皮灰棕色，有的可见灰白色斑块，栓皮脱落处显红棕色。质坚硬。切面木部红棕色或棕色，导管孔多数；韧皮部有树脂状分泌物呈红棕色至黑棕色，与木部相间排列呈数个同心性椭圆形环或偏心性半圆形环；髓部偏向一侧。气微，味涩。大血藤（B错）：【性状鉴别】药材呈圆柱形，略弯曲。表面灰棕色，粗糙，外皮常呈鳞片状剥落，剥落处显暗红棕色，有的可见膨大的节及略凹陷的枝痕或叶痕。质硬，断面皮部红棕色，有数处向内嵌入木部，木部黄白色，有多数细孔状导管，射线呈放射状排列。气微，味微涩。降香（C错）：【性状鉴别】药材呈类圆柱形或不规则块状。表面紫红色或红褐色，切面有致密的纹理。质硬，有油性。气微香，味微苦。苏木（D错）：【性状鉴别】药材呈长圆柱形或对剖半圆柱形。表面黄红色至棕红色，具刀削痕，常见纵向裂缝。质坚硬，断面略具光泽，年轮明显，有的可见暗棕色、质松、带亮星的髓部。气微，味微涩。川木通（E错）：【性状鉴别】药材呈长圆柱形，略扭曲。表面黄棕色或黄褐色，有纵向凹沟及棱线；节处多膨大，有叶痕及侧枝痕。残存皮部易撕裂。质坚硬，不易折断。切片边缘不整齐，残存皮部黄棕色，木部浅黄棕色或浅黄色，有黄白色放射状纹理及裂隙，其间布满导管孔，髓部较小，类白色或黄棕色，偶有空腔。气微，味淡。